中风、痫证、厥证可共有的症状为
A. 口吐涎沫
B. 口眼㖞斜
C. 突然昏迷
D. 四肢抽搐
E. 角弓反张

正确答案：C。突然昏迷

解析：中风是以猝然昏仆，不省人事，半身不遂，口舌歪斜，言语不利为主症的一类疾病；痫证是以突然意识丧失，甚则仆倒，不省人事，两目上视，口吐涎沫，强直抽搐，或口中怪叫，移时苏醒，醒后一如常人为主要临床表现的病证；厥证是以突然昏倒、不省人事、四肢逆冷为主要临床表现的一种病证，故三者均可出现昏迷症状（C对）。